以下哪项不是舌体上分布的乳头
A. 丝状乳头
B. 轮廓乳头
C. 切牙乳头
D. 叶状乳头
E. 菌状乳头

正确答案：C。切牙乳头

解析：本题考查特殊黏膜。切牙乳头位于腭中缝的前端，中切牙的腭侧，为圆形或软圆形不规则的软组织突起（C错，为本题的正确答案）。特殊黏膜即舌背黏膜，表面有许多舌乳头，分为丝状乳头、菌状乳头、轮廓乳头、叶状乳头。丝状乳头数目最多，遍布于舌背，舌尖最多（A对）；轮廓乳头在舌乳头中体积最大，沿界沟排列（B对）；叶状乳头在舌侧缘后部（D对）；菌状乳头分散于丝状乳头之间（E对）。